男，5岁。反复咳嗽两月。查体：体温正常，无浅表淋巴结肿大，无咽部肿大，两肺布满哮鸣音，无水泡音。反复抗生素治疗无效，以往无呛咳病史，有过敏性鼻炎。该患儿的可能诊断是
A. 肺炎
B. 毛细血管炎
C. 咳嗽变异性哮喘
D. 肺结核
E. 气管异物

正确答案：C。咳嗽变异性哮喘

解析：患儿体温正常，无浅表淋巴结肿大、无咽部肿大提示咳嗽并非感染引起，抗生素治疗无效可进一步说明（ABD错）；既往无呛咳史提示并非支气管异物（E错）。有过敏性鼻炎提示患者为过敏体质，由于听诊未闻及哮鸣音，考虑为咳嗽变异型哮喘（C对）。